下列疾病中不属于链球菌属所致化脓性感染疾病的是
A. 淋巴管炎
B. 淋巴结炎
C. 蜂窝织炎
D. 猩红热
E. 脓疱疮

正确答案：D。猩红热

解析：链球菌属所致疾病：人链球菌病十分常见，其中约90%由A群链球菌感染所致。①化脓性感染：淋巴管炎、淋巴结炎、蜂窝织炎、痈、脓疱疮，扁桃腺炎、咽峡炎、鼻窦炎、产褥感染、中耳炎及乳突炎等。②中毒性疾病：猩红热、链球菌毒素休克综合征等。③变态反应性疾病：风湿热、急性肾小球肾炎等。掌握“链球菌属”知识点。